关于上腔静脉，错误的说法是
A. 由左、右头臂静脉汇合而成
B. 注入右心房
C. 收纳头、颈和上肢的静脉血
D. 收纳胸腔内脏的静脉血
E. 收纳胃肠道的静脉血

正确答案：E。收纳胃肠道的静脉血

解析：上腔静脉由左、右头臂静脉汇合而成（A对）。平第3胸肋关节下缘注入右心房（B对）。上腔静脉收集头颈部、上肢（C对）和胸部（心和肺除外）（D对）等上半身（E错，为本题正确答案）的静脉血。